Bass刷牙法又称为
A. 水平颤动法
B. 旋转刷牙法
C. 圆弧刷牙法
D. Fones刷牙法
E. 改良的stillman刷牙法

正确答案：A。水平颤动法

解析：Bass刷牙法又称为水平颤动法。掌握“自我口腔保健方法”知识点。